甲为药品生产企业，发现自己企业的某药品可能产生用药有关的严重不良反应，甲企业必须及时向有关部门进行报告，该部门为
A. 当地省、自治区、直辖市人民政府药品监督管理部门
B. 当地省、自治区、直辖市人民政府药品监督管理部门和卫生行政部门
C. 当地省、自治区、直辖市人民政府卫生行政部门
D. 国务院
E. 国务院卫生行政部门

正确答案：B。当地省、自治区、直辖市人民政府药品监督管理部门和卫生行政部门

解析：《药品管理法》第七十一条：国家实行药品不良反应报告制度。药品生产企业、药品经营企业和医疗机构必须经常考查本单位所生产、经营、使用的药品质量、疗效和反应。发现可能与用药有关的严重不良反应，必须及时向当地省、自治区、直辖市人民政府药品监督管理部门和卫生行政部门报告。具体办法由国务院药品监督管理部门会同国务院卫生行政部门制定。故本题选B。掌握“药品不良反应概念、报告、处置与法律责任”知识点。